不属于弥漫性结缔组织病的疾病是
A. 系统性红斑狼疮
B. 干燥综合征
C. 多肌炎和皮肌炎
D. 类风湿关节炎
E. 骨性关节炎

正确答案：E。骨性关节炎

解析：弥漫性结缔组织病包括：类风湿性关节炎（D对）、红斑狼疮（A对）、硬皮病、多肌炎（C对）、重叠综合症、干燥综合征（B对）、血管炎病等。骨性关节炎（E错，为本题正确答案）属于退行性变，不属于弥漫性结缔组织病。